患者，男，70岁。今日胸痛发作频繁，2小时前胸痛再次发作，含化硝酸甘油不能缓解。检查：血压90/60mmHg，心律不整。心电图Ⅱ、Ⅲ、aVF导联ST段抬高呈弓背向上的单向曲线。应首先考虑的是
A. 心绞痛
B. 急性心包炎
C. 急性前间壁心肌梗死
D. 急性下壁心肌梗死
E. 急性广泛前壁心肌梗死

正确答案：D。急性下壁心肌梗死

解析：本例老年男性患者胸痛频繁发作，含化硝酸甘油不能缓解，心电图显示Ⅱ、Ⅲ、aVF导联ST段抬高，呈弓背向上的单向曲线，应首先考虑为急性下壁心肌梗死（D对）。心绞痛（A错）疼痛一般持续数分钟至十余分钟，多为3～5分钟，很少超过半小时，去除诱因，休息或含服硝酸甘油可缓解。急性心包炎（B错）最具诊断价值的体征为心包摩擦音。其心电图主要表现为：除aRV、V₁导联以外的所有常规导联可能出现ST段呈弓背向下型抬高。急性前间壁心肌梗死（C错）为V₁～V₃导联呈弓背向上型抬高。广泛前壁心肌梗死（E错）为V₁～V₅导联呈弓背向上型抬高。